关于急性非致死性毒性试验说法正确的是
A. 常用评价指标是Limac
B. Limac值越大，表明该受试物急性毒性越大
C. 目的是确定化学物质对机体急性毒性的大小，并进行急性毒性分级
D. 剂量设计一般以LD₁₀作为最高剂量组
E. 以上均正确

正确答案：A。常用评价指标是Limac